医学心理学的基本观点不包括
A. 心身统一的观点
B. 主动适应与调节的观点
C. 认知评价的观点
D. 情绪影响的观点
E. 道德约束的观点

正确答案：E。道德约束的观点

解析：旧版教材中，医学心理学的6个基本观点为：心身统一的观点、社会对个体影响的观点、认知评价的观点、主动适应和调节的观点、情绪因素作用的观点、个性特征作用的观点。心身统一的观点（A对）是指一个完整的个体应包括心、身即精神与躯体两个部分，两者相互影响，对外界环境的刺激，心、身是作为一个整体来反应的。主动调节的观点（B对）是指个体在成长发育过程中，逐渐对外界事物形成了一个特定的反应模式，构成了相对稳定的个性特点，是使个体行为与外界保持相对和谐一致的主要因素。认知评价的观点（C对）是指，心理社会因素能否影响健康或导致疾病，不完全取决于该因素的性质和意义，还取决于个体对外界刺激怎样认知和评价。情绪作用的观点（D对）是指，情绪与健康有着十分密切的关系。个性特征的观点是指，面对同样的社会应激，有的人得病，难以适应，有的人则“游刃有余”，很快度过“难关”，这种现象与个性特征有着十分密切的关系。社会影响的观点是一个完整的个体不仅是生物的人，而且是社会的人，即人生活在一个多层次多等级的系统中。道德约束的观点不是医学心理学的基本观点（E错，为本题正确答案）。